妊娠8周行吸宫术后半月，阴道持续流血，量时多时少。妇科检查：宫口松，子宫如40天妊娠大小，较软，尿妊娠试验阳性，应考虑的诊断为
A. 绒毛膜癌
B. 侵蚀性葡萄胎
C. 子宫内膜炎
D. 吸宫不全
E. 子宫复旧不良

正确答案：D。吸宫不全

解析：患者妊娠8周行吸宫术后半月，阴道流血，量时多时少（手术后阴道流血时间长，血量多或流血停止后再现多量流血，应考虑吸宫不全）。妇科检查：宫口松，子宫如40天妊娠大小，较软（吸宫不全患者的子宫体软较正常大，复旧不良，有时宫颈口松弛、张开）。尿妊娠试验阳性（人工流产术2周以后，尿hCG阳性），应考虑为吸宫不全（D对）。绒毛膜癌（P338）（A错）常表现为葡萄胎排空、流产或足月产后，有持续的不规则阴道流血，量多少不定，但多继发于葡萄胎妊娠，常发生转移，组织学检查可明确诊断。侵蚀性葡萄胎（P338）（B错）全部继发于葡萄胎妊娠。子宫内膜炎（C错）常表现为高热、头痛、白细胞增高、阴道脓血性分泌物等，无阴道持续流血。若胎盘附着面感染，子宫复旧不良（E错）引起出血，常表现为大量阴道出血。